启动子是指
A. DNA分子中能转录的序列
B. 与RNA聚合酶结合的DNA序列
C. 与阻遏蛋白结合的DNA序列
D. 有转录终止信号的序列
E. 与顺式作用元件结合的序列

正确答案：B。与RNA聚合酶结合的DNA序列